临床判断休克重要的指征是
A. 血压
B. 脉搏
C. 皮肤色泽与温度
D. 休克早期心率
E. 尿量

正确答案：D。休克早期心率

解析：临床判断休克的主要指征包括：血压、脉搏、皮肤色泽与温度、尿量等，休克早期心率的变化是重要的指征。掌握“口腔颌面部创伤急救”知识点。